上颌尖牙牙冠唇面形态中正确的是
A. 圆五边形
B. 唇轴嵴两侧各有一条发育沟
C. 近中缘长，近中斜缘短
D. 外形高点在颈1/3与中1/3交界处
E. 以上均正确

正确答案：E。以上均正确

解析：上颌尖牙唇面似圆五边形，颈缘呈弧形，近中缘长，近中斜缘短，远中斜缘长，远中缘短。尖牙初萌出时，近、远中斜缘在牙尖顶端相交成的角约为90°。唇面中部由牙尖顶伸至颈1/3的突起形成唇轴嵴。唇轴嵴两侧各有一条发育沟，唇面的外形高点在中1/3与颈1/3交界处的唇轴嵴上。掌握“上下颌前牙的外形及临床应用解剖”知识点。